根据WHO统计，目前，全球0～14岁儿童的首位死因
A. 结核
B. 营养不良
C. 伤害
D. 麻疹
E. 痢疾

正确答案：C。伤害